使凝血酶由促凝转向抗凝的重要血管内凝血抑制成分是
A. 抗凝血酶-Ⅲ(AT-Ⅲ）
B. 血栓调节蛋白(TM)
C. 组织因子途径抑制物(TFPI)
D. 蛋白S（PS)
E. 蛋白C(PC)

正确答案：B。血栓调节蛋白(TM)

解析：血栓调节蛋白(TM)（B对）使凝血酶由促凝转向抗凝，它是内皮细胞膜上的凝血酶受体之一，与凝血酶结合后降低其凝血活性，却显著增强了凝血酶激活蛋白C的作用，因此，血栓调节蛋白是使凝血酶由促凝转向抗凝的重要的血管内凝血抑制因子。抗凝血酶-Ⅲ(AT-Ⅲ）（A错）主要由肝脏和血管内皮细胞产生，可使FV!Ia、FIXa、FXa、FXla等灭活，AT-Ⅲ数量不足和（或）功能异常可影响抗凝作用导致血栓形成倾向。组织因子途径抑制物(TFPI)（C错）主要由血管内皮细胞合成，是外源性凝血途径的特异性抑制物，具有防止凝血反应扩散的作用。蛋白S(PS)（D错）作为 APC的辅因子，可促进APC清除凝血酶原激活物中的FXa。蛋白C(PC)（E错）在肝脏合成，以酶原形式存在于血液中，凝血酶可将之活化为激活的蛋白C(APC)。